患者，男，76岁，因重症肺炎在ICU治疗，肺泡灌洗液培养提示为耐甲氧西林金黄色葡萄球菌（MRSA），给予利奈唑胺抗感染治疗2周，临床应关注的典型不良反应是
A. 肌肉震颤
B. 红人综合征
C. 抗生素相关性腹泻
D. 急性溶血性贫血
E. 血小板减少

正确答案：E。血小板减少

解析：本题考查利奈唑胺的不良反应。临床应关注的典型不良反应是血小板减少（E对）。利奈唑胺可用于治疗由需氧革兰阳性菌引起的感染，其体外抗菌谱还包括一些革兰阴性菌和厌氧菌。利奈唑胺的常见不良反应为失眠、头痛、腹泻、皮疹、瘙痒、发热、口腔或阴道念珠菌病、真菌感染，用药时间过长（超过28日）时可有骨髓抑制（贫血、白细胞减少和血小板减少）、周围神经病和视神经病（有的进展至失明）、乳酸性酸中毒。由利奈唑胺所致的相关性血小板减少症，欧美国家报道发生率为2.4%，老年人发生率为20.9%，多出现在用药后9.3±3.2日。肌肉震颤（A错）为中枢神经系统疾病的一个症状，主要由于黑质和黑质纹状体通路病变而引起，常见的疾病有脑炎、颅脑损伤、动脉硬化、基底节肿瘤，某些化学物质中毒，如汞、锰的慢性中毒也可以出现肌肉震颤的毒作用表现。红人综合征（B错）以脸、颈、躯干上部斑丘疹样红斑为特征，还可出现寒战、高热、瘙痒、心动过速、血管性水肿、胸痛、头晕等，不同的患者会有不同的表现，严重时可出现低血压及休克，甚至危及生命，多发生于万古霉素滴注过程中，与输注万古霉素的剂量及速度有关。抗生素相关性腹泻（C错）是指应用抗生素后发生的、与抗生素有关的腹泻。溶血性贫血（D错）是由于红细胞破坏速率增加（寿命缩短），超过骨髓造血的代偿能力而发生的贫血，溶血性贫血的根本原因是红细胞寿命缩短，造成红细胞破坏加速的原因可概括分为红细胞本身的内在缺陷和红细胞外部因素异常，前者多为遗传性溶血，后者引起获得性溶血。